治疗因消化道溃疡和月经过多等所致的慢性失血性贫血的药物是
A. 叶酸
B. 维生素B₁₂
C. 维生素K
D. 华法林
E. 硫酸亚铁

正确答案：E。硫酸亚铁

解析：本题考查硫酸亚铁。硫酸亚铁（E对）可治疗因消化道溃疡和月经过多等所致的慢性失血性贫血。叶酸（A错）用于治疗叶酸缺乏及巨幼红细胞性贫血。维生素B₁₂（B错）用于治疗巨幼红细胞性贫血，神经炎、口炎性腹泻等一些列疾病，还可用于恶性贫血。维生素K（C错）为促凝血药。华法林（D错）为抗凝血药。